女，30岁。产后8天，间断发热伴下腹痛3天。最高体温39℃，阴道血性恶露，有异味。检查：宫底脐下1指，有压痛。血WBC25×10⁹/L，N0.90。尿常规未见异常。此时应考虑的诊断是
A. 产后宫缩痛
B. 产后出血
C. 产褥病率
D. 产褥感染
E. 正常产褥

正确答案：D。产褥感染

解析：女性患者，产后发热、疼痛、异常恶露，血WBC25×10⁹/L，N0.90（正常0.4～0.75，升高提示细菌感染），考虑诊断为产褥感染（D对）。产褥病率（C错）为分娩24小时以后的10日内，每日测量体温4次，间隔时间4小时，有2次体温达到或超过38℃方可确诊。产后宫缩痛（A错）属于产褥期正常表现，产后1～2日出现，持续2～3日自然消失，多见于经产妇。正常产褥（E错）的产后体温多数在正常范围内，可在产后24小时内略升高，一般不超过38℃。